急性风湿热诊断标准中的主要表现不包括
A. 心肌炎
B. 关节痛
C. 舞蹈病
D. 环形红斑
E. 皮下小结

正确答案：B。关节痛

解析：风湿热诊断标准主要表现包括心脏炎（A对）、多关节炎、舞蹈病（C对）、环形红斑（D对）和皮下结节（E对）。次要表现包括关节痛（B错，为本题正确答案）、发热、急性反应物和心电图P-R间期延长。